治阳虚证，使用补阳药时常佐用少量补阴药的方法称为
A. 阴阳互制
B. 阳病治阴
C. 阴病治阳
D. 阳中求阴
E. 阴中求阳

正确答案：E。阴中求阳

解析：本题考查的是阴阳偏衰的治疗原则。治阳虚证，使用补阳药时常佐用少量补阴药的方法称为阴中求阳（E对）。阴阳偏衰，即阴或阳的虚损不足，或为阴虚，或为阳虚。阴阳偏衰的治疗原则是“补其不足”“虚则补之”。阴虚不能制阳而致阳亢者，属虚热证，一般不能用寒凉药直折其热，须“壮水之主，以制阳光”，即用滋阴壮水之法以抑制阳亢火盛，这种治疗原则亦称为“阳病治阴（B错）”。若阳虚不能制阴而造成阴盛者，属虚寒证，不宜用辛温发散药以散阴寒，须“益火之源，以消阴翳”，即用扶阳益火之法以消退阴盛，这种治疗原则也称为“阴病治阳（C错）”。对阴阳偏衰的治疗，明代张景岳根据阴阳互根的原理，提出了阴中求阳、阳中求阴（D错）的治法，即是指在用补阳药时，须佐用补阴药；在用补阴药时，须佐用补阳药，以发挥其互根互用的生化作用。阴阳互制（A错）指的是阴阳的对立制约。阴阳对立，是指事物或现象中阴与阳两个方面，具有阴阳相反、相互制约的关系，又称“阴阳对待”。人体之所以能进行正常的生命活动，就是阴与阳相互制约，取得了相对的动态平衡，称之为“阴平阳秘”。